可以参加执业医师资格考试的条件中，不包括
A. 高等学校医学专业本科以上学历
B. 在执业医师指导下，在医疗机构试用期满1年
C. 在执业医师指导下，在预防机构试用期满1年
D. 在执业医师指导下，在保健机构试用期满1年
E. 在执业医师指导下，在卫生行政管理机构试用期满1年

正确答案：E。在执业医师指导下，在卫生行政管理机构试用期满1年

解析：执业医师资格考试的条件是：本科以上学历，在医疗预防保健机构中试用期满一年。